其对映异构体产生相反活性的药物是
A. 丙氧酚
B. 依托唑啉
C. 异丙嗪
D. L-甲基多巴
E. 氯苯那敏

正确答案：B。依托唑啉

解析：本题考查药物的手性特征及其对药物作用的影响。依托唑啉（B对）的对映异构体产生相反活性。利尿药依托唑啉的左旋体具有利尿作用，而其右旋体则有抗利尿作用，因为这类药物的对映体与受体均有一定的亲和力，但通常只有一种对映体具有活性，另一对映体反而起拮抗剂的作用。丙氧酚（A错）的对映异构体产生不同类型的药理活性，右丙氧酚是镇痛药，左丙氧酚是镇咳药，这两种对映体在临床上用于不同的目的，作用于不同的靶器官。异丙嗪（C错）对映异构体之间活性强度相同，均为抗组胺药。抗高血压药物L-甲基多巴（D错）仅L-构型的化合物有效，对映异构体无活性。氯苯那敏（E错）的对映异构体产生相同的药理活性，但强弱不同，其右旋体的活性高于左旋体。